属于软膏剂防腐剂的是
A. 十八醇
B. 月桂醇硫酸钠
C. 司盘80
D. 甘油
E. 羟苯乙酯

正确答案：E。羟苯乙酯

解析：本题考查软膏剂的基质与附加剂。羟苯乙酯（E对）常作为软膏剂的防腐剂；十八醇（A错）为软膏剂的油相基质。月桂醇硫酸钠（B错）、司盘80（C错）均为乳化剂。甘油（D错）为软膏剂的保湿剂。